某男，56岁，睾丸坠胀冷痛，右侧少腹时痛，痛引会阴，畏寒肢冷，舌淡苔白，脉弦有力。临床诊断最有可能是
A. 肾阳虚证
B. 肾气不固证
C. 寒滞肝脉证
D. 肝气郁结证
E. 寒湿下注证

正确答案：C。寒滞肝脉证

解析：寒滞肝脉证是由寒邪侵袭，凝滞肝经所致。寒为阴邪，易伤阳气，性收引、凝滞，足厥阴肝经绕阴器，循少腹，故寒凝肝脉可见少腹冷痛，并牵引睾丸坠胀冷痛，痛引会阴；兼有畏寒肢冷，舌淡苔白，脉弦有力等实寒症状（C对）。